受精卵
A. 精子与卵子结合
B. 受精卵女性子宫内孕育成胚胎、胎儿直至分娩的整个过程，即是生育的全过程
C. 胎儿娩出后母亲要哺乳，保证新生儿正常发育成长
D. 计划生育既要控制人口数量，又要提高人口素质
E. 计划生育只要控制人口数量

正确答案：A。精子与卵子结合

解析：本题考查受精卵的定义。受精卵是指精子与卵子结合（A对BCDE错），受精过程约需24小时。当一个获能的精子进入一个次级卵母细胞的透明带时，受精过程即开始。到卵原核和精原核的染色体融合在一起时，则标志着受精过程的完成，受精卵形成。